以下哪一项是喙突上附着的肌肉
A. 颞肌
B. 颊肌
C. 咀嚼肌
D. 翼内肌
E. 翼外肌

正确答案：A。颞肌

解析：下颌支其上端有喙突和髁突（关节突），喙突上有颞肌和咬肌附着，髁突颈部下方有翼外肌下头附着：两突之间有下颌切迹（乙状切迹）。掌握“下颌骨及腭骨解剖特点”知识点。